有关氧化磷酸化的叙述错误的是
A. 物质在氧化时伴有ADP磷酸化生成ATP的过程
B. 氧化磷酸化过程涉及两种呼吸链
C. 电子分别经两种呼吸链传递至氧，均产生3分子ATP
D. 氧化磷酸化过程存在于线粒体内
E. 氧化与磷酸化过程通过偶联而产能

正确答案：C。电子分别经两种呼吸链传递至氧，均产生3分子ATP